关于临床预防原则，下列哪项不正确？
A. 医患双方共同决策
B. 重视危险因素的收集
C. 以健康咨询为先导
D. 以健康体检为主
E. 合理选择健康筛检的内容

正确答案：D。以健康体检为主

解析：临床预防的原则：在具体预防干预措施 ，注重不良行为、生活方式等危险因素的收集和纠正（A对），强调医患双方以相互尊重的方式进行健康咨询并共同决策（BC对），重视第一级和第二级预防的结合，开展疾病的早期诊断和早期治疗，推行临床与预防一体化、连续性的卫生保健服务（E对）。